下列属于前臂伸肌的是
A. 小指伸肌
B. 掌长肌
C. 旋前圆肌
D. 旋前方肌
E. 无

正确答案：A。小指伸肌

解析：小指伸肌（A对）伸小指，故属于前臂伸肌。掌长肌（B错）屈腕，紧张掌腱膜，旋前圆肌（C错）使前臂旋前，屈肘，故属于前臂屈肌，而非前臂伸肌。旋前方肌（D错）使前臂旋前，故也不属于前臂伸肌。